为保证建筑物清洁及学生如厕方便，《中小学校建筑设计规范》规定小学教学楼中的学生厕所设置标准是
A. 女生每13名学生设1个大便器；男生每40名学生设1个大便器
B. 女生每10名学生设1个大便器；男生每20名学生设1个大便器外加1m小便槽
C. 女生每15名学生设1个大便器；男生每25名学生设1个大便器外加1m小便槽
D. 女生每20名学生设1个大便器；男生每30名学生设1个大便器外加1m小便槽
E. 女生每25名学生设1个大便器；男生每35名学生设1个大便器外加1m小便槽

正确答案：A。女生每13名学生设1个大便器；男生每40名学生设1个大便器